2cmx2cmx2cm肿物，无疼痛，质地韧，不光滑，界限不清，基底不粘连，推之可移动。应首先考虑的是
A. 乳癖
B. 乳疬
C. 乳痨
D. 乳岩
E. 乳腺增生病

正确答案：C。乳痨

解析：该患者符合乳痨的特点：乳房结块如梅李，不痛，边界不清，皮肉相连，肿块化脓，溃后脓出稀薄，疮口不易收敛，病程缓慢（C对）。乳癖可见单侧或双侧乳房疼痛并出现肿块，乳痛和肿块与月经周期及情志变化密切相关（A错）。乳疬的特点是乳晕中央有扁圆形肿块，质地中等，有轻压痛，与题干不符（B错）。乳岩可见肿块推之不移，与题干不符（D错）。乳腺增生病可见乳房肿块，经前肿痛加重，经后减轻，亦不符（E错）。